治疗大汗不止体虚欲脱，应选用的药物是
A. 覆盆子
B. 海螵蛸
C. 金樱子
D. 芡实
E. 山茱萸

正确答案：E。山茱萸

解析：山茱萸酸涩性温，能敛汗固脱，为防止元气虚脱之要药。可治疗大汗不止，体虚欲脱或久病虚脱（E对）。覆盆子治疗肾虚不固，遗精滑精，遗尿尿频，阳痿早泄；肝肾不足，目暗昏花（A错）。海螵蛸治疗吐血衄血，崩漏便血，外伤出血；遗精滑精，赤白带下；胃痛吞酸；湿疹湿疮，溃疡不敛（B错）。金樱子治疗遗精滑精，遗尿尿频，崩漏带下；久泻，久痢（C错）。芡实治疗肾虚遗精滑精，遗尿尿频；脾虚久泻；白浊，带下（D错）。